宜于晨起或餐前顿服的质子泵抑制剂是
A. 奥美拉唑
B. 地塞米松
C. 枸橼酸铋钾
D. 多潘立酮
E. 法莫替丁

正确答案：A。奥美拉唑

解析：本题考查药物的使用。奥美拉唑（A对）属于质子泵抑制剂，空腹服药吸收快，在晨起或餐前30min内服用比较好。法莫替丁（E错）在餐后或睡前服用效果比较好。地塞米松（B错）用药时间因给药方式不同而不同。枸橼酸铋钾（C错）属于胃黏膜保护剂，宜在餐前1h或睡前服用。多潘立酮（D错）属于促动力药，宜在餐前15～20min服用。